最易受不良因素影响而发生流产死胎的胎龄是
A. 6周
B. 12周
C. 20周
D. 24周
E. 28周

正确答案：C。20周

解析：死胎：妊娠20周后胎儿在子宫死亡。 流产：1、早期流产＜12周，胚胎因素，常见染色体异常；2、晚期流产12周～27+6周，常见因素母体因素如宫颈裂伤。 胎盘早剥：20周以后 早产：28周～36+6周 前置胎盘：妊娠28周以后。
死胎的定义：妊娠20周后胎儿在子宫内死亡。      
受外界影响死胎    20周。
受外界影响先天畸形，夭折   12周。
20周:妊高症，胎盘早剥，死胎。（饿死（20）胎中）
28周:早产，流产，前置胎盘。